26岁男患者，有不洁性交史和吸毒史，近半年来出现体重下降，腹泻，发热，反复出现口腔真菌感染，初诊为AIDS。确诊时需要参考的主要检测指标是
A. HIV相应的抗原
B. HIV相应的抗体
C. AIDS患者的补体
D. HIV相关的CD8+细胞
E. HIV相关的CD4+细胞

正确答案：B。HIV相应的抗体

解析：临床上常用的实验室检测HIV感染指标，主要用于AIDS或HIV感染者的诊断并指导用药，监测高危人群以便及时发现传染源，控制其继续传播。掌握“人类免疫缺陷病毒”知识点。